患者，女，62岁，医师处方如下：姓名：XXX，性别：女，年龄：62。临床诊断：2型糖尿病高血压2期高血脂PCI术后，R：二甲双胍片0.25g×48×3盒/0.5gtidPo餐中，阿卡波糖片50mg×30×3盒/50mgtidpo与第一口饭同服，氯吡格雷片75mg×7×4盒/750mgtidpo清晨，氨氯地平片5mg×7×4盒/5mgtidpo餐后，辛伐他汀片20mg×7×4盒/20mgqdpo清晨。本处方中，单次给药剂量错误的是
A. 二甲双胍
B. 阿卡波糖
C. 氯吡格雷
D. 氨氯地平
E. 辛伐他汀

正确答案：C。氯吡格雷

解析：本题考查药物的使用。氯吡格雷（C错，为本题正确答案）治疗急性冠脉综合征的患者，应以单次负荷量300mg开始，以75mg，每日1次连续服药。二甲双胍片（A对）应从小剂量开始使用，根据病人状况，逐渐增加剂量，通常本品的起始剂量为0.5克。阿卡波糖（B对）片起始剂量为一次50mg（一次1片），一日3次。氨氯地平（D对）片起始剂量为5mg，每日一次，最大不超过10mg，每日一次。辛伐他汀（E对）片每天晚上20mg作为起始剂量，但应夜间给药。